胶粘剂约占牙膏含量的
A. 1%～2%
B. 2%～4%
C. 20%～40%
D. 20%～60%
E. 0.1%～0.5%

正确答案：A。1%～2%

解析：胶粘剂约占1%～2%，其作用是防止在贮存期间同体与液体成分分离，保持均质性，常用有机亲水胶体，如羧甲基纤维素钠及合成纤维素衍生物。掌握“自我口腔保健方法”知识点。